下列关于五脏外合五体叙述，错的是
A. 心合脉
B. 肝合爪
C. 脾合肉
D. 肺合皮
E. 肾合骨

正确答案：B。肝合爪

解析：筋依赖肝血和肝气的濡养，故称肝在体合筋（B错，为本题正确答案）。心合脉（A对）。脾合肉（C对）。肺合皮（D对）。肾合骨（E对）。